与气生成相关的两脏是
A. 肝与脾
B. 心与脾
C. 心与肺
D. 脾与肺
E. 肝与肺

正确答案：D。脾与肺

解析：本题考查的是五脏之间的关系。与气生成相关的两脏是脾与肺（D对）。脾与肺的关系，主要表现在气的生成和津液的输布代谢两个方面。肝与脾（A错）的关系，主要表现在饮食物的消化和血液生成、贮藏及运行方面。心与脾（B错）的关系，主要表现在血液的生成和运行两方面。心与肺（C错）的关系，主要表现在心主血与肺主气、心主行血与肺主呼吸之间的关系。肝与肺（E错）的关系，主要表现于气机的调节。